下列关于五行生克规律的叙述，错误的是
A. 木为水之子
B. 火为土之母
C. 水为火之所不胜
D. 金为木之所胜
E. 木为土之所不胜

正确答案：D。金为木之所胜

解析：本题考查五行之间的相生相克关系。《难经》中将五行相生关系比喻为母子关系，"生我"者为母，"我生"者为子。按照五行相生次序，水生木，故木为水之子（A对）；火生土，故火为土之母（B对）。《内经》中将相克关系称为为“所胜”“所不胜”关系，即“克我者”为“所不胜”，“我克”者为“所胜”，根据五行相克的关系，水克火，故水为火之所不胜（C对）；金克木，故金为木之所不胜（D错，为本题正确答案）；木克土，故木为土之所不胜（E对）。